按目标人群或场所划分，健康教育的内容不包括
A. 社区健康教育
B. 学校健康教育
C. 心理健康教有
D. 患者健康教育
E. 职业人群健康教育

正确答案：C。心理健康教有